若患者用药后发生严重不良反应，执业药师应首选的应对措施是
A. 检查药品质量
B. 退药息事
C. 处置不良反应
D. 赔偿患者
E. 降价销售该药

正确答案：C。处置不良反应

解析：本题考查的是投诉的类型。若患者用药后发生严重不良反应，执业药师应首选的应对措施是处置不良反应（C对）。1.投诉的类型：（1）服务态度和质量：目前我国大多数医疗机构、社会药房中的药师服务态度尚不尽人意，服务质量和专业水平尚有待于提高。门诊药房和社会药房是药学服务工作的窗口，药师的工作承受着很大的压力。由于药房调剂往往是患者就医流程中接受的最后服务程序，因此，药房调剂服务质量的优劣直接影响药物治疗的安全性和有效性，影响患者的心情。（2）药品数量：此类投诉占有相当的比例。我们通过适当的工作和加强核对可降低此类投诉。（3）药品质量：投诉往往发生在患者取药后发现与过去用过的药有外观上的差异，从而怀疑药品的质量存在问题。对确属药品质量有间题的，应立即予以退换。对包装改变或更换品牌等引致患者疑问的，应耐心细致地予以解释，使患者恢复对药物治疗的信心。（4）退药：由于各种原因认为药品不适合自已使用，要求退药投诉的原因比较复杂，既有患者方面的，也有医院和医师方面的。有证据显示，由于医师对药物的作用、不良反应、适应证、禁忌证、规格、剂量、用法等信息不甚了解，从而处方不当，造成了越来越多的此类投诉。对患者要求退药应制订管理办法，处理办法既要考虑医院和药店的利益，也应对患者的要求给予充分尊重，同时也应规范医师的处方行为，从根源上减少此类投诉的发生。（5）用药后发生严重不良反应：对这类投诉应会同临床共同应对，原则上应先处理不良反应，减轻对患者造成的伤害。（6）价格异议：药品价格是一个较为敏感的问题，医疗单位和药店应严格、认真执行国家药品价格政策。如因招标或国家药品价格政策调整价格，应认真耐心地向患者解释；确因价格或收费有误的，应查找原因并退还多收费用。